根据现行GSP的规定，药品零售中处方审核人员应是执业药师或有
A. 药学或相关专业的学历，或者具有药学专业的技术职称
B. 药学专业技术职称
C. 相应的药学专业技术职称
D. 执业药师资格
E. 主管药师以上专业技术职称

正确答案：D。执业药师资格

解析：本题考查药品零售企业经营和质量管理人员的资质要求。根据现行GSP的规定药品零售中企业负责人应有执业药师资格（D对）；企业应当按照国家有关规定配备执业药师，负责处方审核，指导合理用药。